可阻止血液返流入右心房
A. 三尖瓣
B. 二尖瓣
C. 冠状窦口
D. 主动脉瓣
E. 腱索

正确答案：A。三尖瓣

解析：三尖瓣（A对）靠拢紧闭，使瓣膜不致翻向心房，可阻止血液返流入右心房。